下列医患关系中，属于技术关系的是
A. 医务人员对患者良好的服务态度
B. 医务人员对患者高度的责任心
C. 医务人员对患者的同情和尊重
D. 医务人员以精湛医术为患者服务
E. 患者对医务人员的尊重

正确答案：D。医务人员以精湛医术为患者服务

解析：属于技术关系的是医务人员以精湛医术为患者服务。医患之间的技术关系是指医患双方围绕诊断、治疗、护理，以及预防、保健、康复等具体医学行为中技术因素所构成的互动关系。这是医患关系最主要、最基本的形式（D对）。